一男青年发热，休克。3日前开始头痛入院，当日意识不清，昏迷，体温41℃，血压70/30mmHg，躯干皮肤出现红色斑点。用药后血压仍继续下降，第3天死亡。血培养发现革兰阴性双肾状球菌生长。请问导致感染的病原菌最可能是
A. 乙型溶血性链球菌
B. 脑膜炎奈瑟菌
C. 肠侵袭性大肠埃希菌
D. 肺炎链球菌
E. 金黄色葡萄球菌

正确答案：B。脑膜炎奈瑟菌